总体的定义是指根据研究目的确定的
A. 所有样本的全体
B. 观察单位的全体
C. 根据研究目的确定的同质观察单位的全体
D. 观察单位某种变量值的集合
E. 样本中同质观察单位某种变量值的集合

正确答案：C。根据研究目的确定的同质观察单位的全体

解析：本题考查总体的定义。总体是根据研究目的确定的同质研究个体的全体（C对ABDE错）。